患者男，34岁，左下第二磨牙（牙合）面深大龋洞，探诊敏感，未探及穿髓孔，叩痛（-），松动Ⅰ°。冷水入洞疼痛明显，去除刺激后疼痛立刻缓解，热测同对照牙。X线检查，龋洞极近髓，根尖周未见异常。牙槽骨吸收至根中1/3。若去腐时敏感，则关于治疗方法选择正确的是
A. 根管治疗
B. 根尖诱导成形术
C. 牙拔除术
D. 安抚治疗
E. 活髓切断术

正确答案：D。安抚治疗

解析：患者的主观临床症状较明显，仍为温度刺激痛性质，程度较重，洞底软龋能彻底去净，但极近髓，甚至髓角已透红，可先用氧化锌丁香油糊剂做安抚疗法或行间接盖髓，待1～2周复诊后症状消除后，再行复合树脂粘接修复或垫底充填。若症状未能缓解，需再进一步检查，考虑是否需做牙髓治疗。掌握“深龋的治疗”知识点。